根据《麻醉药品和精神药品管理条例》，区域性批发企业从定点生产企业购进第一类精神药品，须经过批准的部门是
A. 县级药品监督管理部门
B. 省级卫生行政部门
C. 省级药品监督管理部门
D. 国家药品监督管理部门
E. 国家卫生行政部门

正确答案：C。省级药品监督管理部门

解析：本题考查特殊药品的管理。根据《麻醉药品和精神药品管理条例》，区域性批发企业从定点生产企业购进第一类精神药品的，需经批准的部门是省级药品监督管理部门（C对）。